不属于突发环境污染事件的是
A. 重点流域、敏感水域水污染事件
B. 重点城市大气污染事件
C. 城市居民区火灾事件
D. 海上油轮溢油或有毒化学品泄漏事件
E. 有毒化学品、放射性物品污染农田事件

正确答案：C。城市居民区火灾事件

解析：本题考查突发环境污染事件。突发环境污染事件是指在社会生产和人民生活中所使用的化学品、易燃易爆危险品、放射性物品，在生产、运输、贮存、使用和处置等环节中，由于操作不当、交通肇事或人为破坏而造成的爆炸、泄漏，从而造成环境污染和人民群众健康危害的恶性事故。按突发环境污染事件所涉及的地域空间（或介质）分类可分为：1.重点流域、敏感水域水污染事件（A对）；2.重点城市大气污染事件（B对）；3.有毒化学品、放射性物品污染农田事件（E对）；5.海上油轮溢油或有毒化学品 泄漏事件（D对）。城市居民区火灾事件（C错，为本题正确答案）不属于突发环境污染事件。